下列哪一作用与吗啡治疗心源性哮喘的机制无关
A. 有强大的镇痛作用
B. 有明显的镇静作用
C. 消除患者焦虑、恐惧情绪
D. 血管扩张、心脏负荷减轻
E. 降低呼吸中枢对CO2的敏感性

正确答案：A。有强大的镇痛作用